经脉十二者，伏行于
A. 躯干
B. 分肉之间
C. 头面
D. 四肢
E. 全身

正确答案：B。分肉之间

解析：对经络的形态，《灵枢·经脉》：“经脉十二者，伏行于分肉之间，深而不见…诸脉之浮而常见者，皆络脉也。”明确指出，经脉的形态是不能直接看见，其实质是深藏于分肉间隙之中（B对），体表的经脉循行线只是经脉的示意图，而不是经脉的实体。据此，后世医家多认为：经脉多深而不见，行于分肉之间，络脉多浮而常见，行于体表较浅部位；经脉较粗大，络脉较细小；经脉以纵行为主，络脉则纵横交错，网络全身。